水质处理器中的过滤材料对改善水质具有良好作用，但也可能存在一些隐患，可能导致含氨氮水中亚硝酸盐含量增加的过滤材料是
A. 活性炭
B. 三碘树脂
C. 五碘树脂
D. 黄金碳
E. KDF

正确答案：A。活性炭

解析：本题考查可能导致含氨氮水中亚硝酸盐含量增加的过滤材料。水质处理器中的过滤材料主要以活性炭（A对BCDE错）为主，它的优点是吸附效果好，可吸附水中有机物，可使水的浊度、色度、有机物和重金属等均明显降低。但也可能存在一些隐患，可能导致含氨氮水中亚硝酸盐含量增加。